组成核酸分子的碱基主要有
A. 2种
B. 3种
C. 4种
D. 5种
E. 6种

正确答案：D。5种

解析：本题考查组成核酸分子的碱基。组成核酸分子的碱基主要有5种（D对），包括腺嘌呤（A）、鸟嘌呤（G）、尿嘧啶（U）、胸腺嘧啶（T）和胞嘧啶（C）。